根据《处方管理办法》，医疗机构普通处方的印刷用纸为
A. 淡红色
B. 淡绿色
C. 白色
D. 淡黄色
E. 淡蓝色

正确答案：C。白色

解析：本题考查的是处方颜色。根据《处方管理办法》，医疗机构普通处方的印刷用纸为白色（C对）。处方颜色：普通处方的印刷用纸为白色；急诊处方印刷用纸为淡黄色（D错），右上角标注“急诊”；儿科处方印刷用纸为淡绿色（B错），右上角标注“儿科”；麻醉药品和第一类精神药品处方印刷用纸为淡红色（A错），右上角标注“麻、精一”；第二类精神药品处方印刷用纸为白色，右上角标注“精二”。